关于处方开具和调剂的说法，正确的是
A. 处方开具后7日内有效
B. 调剂处方时应做到“四查十对”
C. 调剂处方时“四查”是指查对药名、剂型、规格和数量
D. 应使用淡红色处方开具第二类精神药品
E. 工作3年及以上的执业医师可开具麻醉药品处方

正确答案：B。调剂处方时应做到“四查十对”

解析：本题考查处方开具和调剂。药师调剂处方时应做到“四查十对”（B对），即查处方，对科别、姓名、年龄；查药品，对药名、剂型、规格、数量；查配伍禁忌，对药品性状、用法用量；查用药合理性，对临床诊断。处方一般是当天有效（A错），特殊情况需要延长时间，必须有医师注明签字。调剂处方时“四查”是指查处方，查药品，查配伍禁忌，查用药合理性（C错）。麻醉药品和第一类精神药品处方的印刷用纸为淡红色，第二类精神药品（D错）处方的印刷用纸为白色。具有处方权的执业医师可开具麻醉药品处方（E错）。